下述临终关怀的特点中，正确的是
A. 临终关怀的主要对象为临床患者
B. 临终关怀应积极治疗，不惜一切代价挽救生命
C. 临终关怀应积极治疗，努力延长患者生存时间
D. 临终关怀应提供家庭式的爱抚与关怀
E. 临终关怀由临床医务人员实施，不应吸纳非专业人员参与

正确答案：D。临终关怀应提供家庭式的爱抚与关怀

解析：A.临终关怀的主要对象为不可逆转的临床患者；B、C临终关怀的主要目的不是治疗或治愈疾病，而是减轻患者的身心痛苦、控制症状，采取姑息对症和支持疗法，给予患者生活护理、临终护理和心理安慰；E.临终关怀的服务团队，以医务人员为主，同时家属、社会团体和各界人士等大量社会志愿者的积极参与，已发展成为一项公益事业。掌握“临终关怀伦理”知识点。